通过向病人提供决策支持和自我管理支持来鼓励其合理利用医疗服务属于
A. 生活方式管理
B. 需求管理
C. 疾病管理
D. 残疾管理
E. 综合健康管理

正确答案：B。需求管理